相邻多数毛囊及其附件同时发生急性化脓性炎症者
A. 疖
B. 痈
C. 脓肿
D. 丹毒
E. 冷脓肿

正确答案：B。痈

解析：相邻多数毛囊及其附件同时发生急性化脓性炎症者称痈，其病变波及皮肤深层毛囊间组织时，可沿筋膜浅面扩散波及皮下脂肪层，造成较大范围的炎性浸润或组织坏死。掌握“面部疖痈”知识点。